理想根管充填材料的性能要求之一是
A. 无X线阻射性
B. 固化时体积收缩
C. 操作简便不易取出
D. 不刺激根尖周组织
E. 不需具有抗菌作用

正确答案：D。不刺激根尖周组织

解析：本题考查根管充填材料的性能。理想根管充填材料的性能要求之一是不刺激根尖周组织（D对）。根管充填材料是用于根管治疗术中充填根管、消除死腔、防止根管内再感染的材料，理想根管充填材料得性能要求为：①不刺激根尖周组织，能促进根尖周病变的愈合；②固化时体积不收缩（B错），凝固后与根管壁无间隙；③有X线阻射性（A错），便于检查是否充填完善；④能用简单方法即可将根管充填完满，操作简便易取出（C错）；⑤能长期保存在根管中而不被吸收；⑥不使牙体变色；⑦充填根管后有持续的抗菌作用（E错）。目前临床上常用的根管充填材料是牙胶尖和根管封闭剂。